晚期宫颈癌患者出现无尿，其肾衰竭原因最可能是
A. 急性间质性肾炎
B. 肾后性急性肾衰竭
C. 肾前性氮质血症
D. 急性肾小管坏死
E. 急进性肾小球肾炎

正确答案：B。肾后性急性肾衰竭

解析：晚期宫颈癌患者出现无尿（说明宫颈癌晚期，肿瘤压迫输尿管，引起尿路梗阻），其肾衰竭原因最可能是肾后性急性肾衰竭（B对），肾后性AKI源于急性尿路梗阻，从肾盂到尿道任一水平尿路上均可发生梗阻。急性间质性肾炎（A错）、急性肾小管坏死（D错）、急进性肾小球肾炎（E错）都属于肾性AKI，有肾实质损伤，患者出现无尿的症状是因为宫颈癌晚期肿瘤压迫输尿管，并未提到有肾实质损伤。肾前性氮质血症（C错）是因低血容量引起肾灌注不足，造成肾小球滤过率和肾排泄功能降低，以致氮质贮留引起的结果。